肾孟肾炎时常可出现的是
A. 白细胞管型
B. 蜡样管型
C. 脂肪管型
D. 红细胞管型
E. 颗粒管型

正确答案：A。白细胞管型

解析：肾盂肾炎是常可出现的是白细胞管型（A对）。蜡样管型常见于严重的肾小管变性坏死性疾病、慢性肾衰等（B错）。脂肪管型常见于肾病综合征、慢性肾小球肾炎急性发作及其他肾小管损伤性疾病（C错）。红细胞管型多见于泌尿系肿瘤、结石等（D错）。颗粒管型常见于慢性肾炎等（E错）。